一位年轻医生的住院医师建议一位高血压患者注意清淡饮食，这位患者认为自己的生活经验比这位医生多得多，故而没有听从，出现这种情况的最根本原因是
A. 患者常常自以为是
B. 医生没有丰富的经验
C. 医生太年轻，说话没分量
D. 没有建立良好的医患关系
E. 患者的角色行为缺如

正确答案：D。没有建立良好的医患关系

解析：题中患者对年轻的住院医生依从性差的最根本原因是没有建立良好的医患关系（D对）。医患在医学问题上，信息不对等，医生拥有更多的相关医学知识，医生有义务对患者进行健康教育，解答和提供关于患者继斌过得医学知识，知道患者的健康管理，促进康复。医患沟通是影响医患关系最重要的因素，年轻医生应该使用沟通技巧与患者达成良好沟通，从而提高患者依从性。角色行为缺如（E错）是指病人未能进入病人角色，不承认自己是病人。患者自以为是（A错）、医生没有丰富经验（B错）、医生太年轻说话没分量（C错）均不是导致问题的根本原因。